X线显示干骺端圆形边界清楚的透亮区。骨皮质变薄，无骨膜反应的疾病是
A. 骨囊肿
B. 骨巨细胞瘤
C. 骨软骨瘤
D. 骨肉瘤
E. 骨纤维异常增殖症

正确答案：A。骨囊肿

解析：干骺端圆形边界清楚的透亮区，骨皮质变薄，无骨膜反应为骨囊肿（A对）的典型X线表现。骨巨细胞瘤（B错）X线表现为骨端偏心位、溶骨性、囊性破坏而无骨膜反应，病灶呈肥皂泡样改变。骨软骨瘤（C错）X线表现为干骺端外生性的骨性突起。骨肉瘤（D错）典型的X线表现为Codman三角或呈“日光射线”征，骨膜反应明显。骨纤维异常增殖症（P780）（E错）亦称骨纤维发育不良，X线表现为受累骨骼膨胀变粗，密质骨变薄，典型特征是呈磨砂玻璃样改变，界限清楚。